常用于治疗痴呆中风半身不遂的腧穴是
A. 侠溪
B. 悬钟
C. 丘墟
D. 足窍阴
E. 足临泣

正确答案：B。悬钟

解析：悬钟属于足少阳胆经腧穴，位于小腿外侧，外踝尖上3寸，腓骨前缘。悬钟主治①痴呆、中风等髓海不足疾患（B对）②颈项强痛，胸胁满痛，下肢痿痹。侠溪主治：①惊悸②头痛、眩晕、耳鸣、耳聋、目赤肿痛等五官病证③胁肋疼痛、膝股痛、足跗肿痛等痛证④乳痈⑤热病（A错）。丘墟主治：①目赤肿痛、目翳等目疾②颈项痛、腋下肿、胸胁痛、外踝肿痛等痛证③足内翻，足下垂（C错）。足窍阴主治：①头痛、目赤肿痛、耳鸣、耳聋、喉痹等头面五官病证②胸胁痛、足跗肿痛③不寐④热病（D错）。足临泣主治：①偏头痛、目赤肿痛、胁肋疼痛、足跗肿痛等痛证②月经不调，乳少，乳痈③疟疾④瘰疬（E错）。